下列膜剂的成膜材料中，其成膜性、抗拉强度、柔韧性、吸湿性及水溶性最好的为
A. 聚乙烯吡啶衍生物
B. 玉米朊
C. 聚乙烯胺类
D. 聚乙烯醇
E. 阿拉伯胶

正确答案：D。聚乙烯醇

解析：本题考查的是膜剂成膜材料的特点。下列膜剂的成膜材料中，其成膜性、抗拉强度、柔韧性、吸湿性及水溶性最好的为聚乙烯醇（D对）。膜剂系指原料药物与适宜的成膜材料经加工制成的膜状制剂。供口服或黏膜用。成膜材料：常用的成膜材料有聚乙烯醇、丙烯酸树脂类、纤维素类及其他天然高分子材料。有天然（淀粉、纤维素、明胶、白及胶等）及合成（纤维素衍生物、聚乙烯醇等）两大类。最常用的是聚乙烯醇（PVA），其性质主要由聚合度和醇解度来决定。聚合度越大，水溶性越差。在温水中能很快地溶解，成膜性、脱膜性以及膜的抗拉强度、柔软性、吸湿性良好，并且无毒、无刺激性。在消化道中吸收很少，80%在48小时内从大便中排泄。聚乙烯吡啶衍生物（A错）、玉米朊（B错）、聚乙烯胺类（C错）与阿拉伯胶（E错）的特点，2022年考试指南未明确说明。